激活的Tc使靶细胞裂解的主要因素是
A. 颗粒酶
B. IL-12
C. 穿孔蛋白+颗粒酶+Fas和FasL
D. γ-IFN
E. Fas配体

正确答案：C。穿孔蛋白+颗粒酶+Fas和FasL

解析：CTL和靶细胞接触后向靶细胞释放穿孔素和颗粒酶。掌握“B细胞、T细胞介导的免疫应答”知识点。